消化性溃疡最主要的病因是
A. 前列腺素合成增加
B. 缺血缺氧
C. 表皮生长因子合成减少
D. 急性应激事件
E. 幽门螺杆菌感染

正确答案：E。幽门螺杆菌感染

解析：消化性溃疡最主要的病因是幽门螺杆菌感染（E对）。其余选项（ABCD错）均不是最主要的病因。